能够阻止细菌合成二氢叶酸从而发挥抑菌作用的药物是
A. 利巴韦林
B. 氟康唑
C. 左氧氟沙星
D. 磺胺类药物
E. 四环素

正确答案：D。磺胺类药物

解析：磺胺类药物可与之竞争二氢蝶酸合酶，阻止细菌的二氢叶酸的合成，从而发挥抑菌作用。掌握“氟康唑、利巴韦林及阿昔洛韦”知识点。